成人摄入混合膳食时，因食物特殊动力作用所消耗的能量约相当于基础代谢的
A. 5%
B. 10%
C. 15%
D. 20%
E. 12%

正确答案：B。10%